长期大剂量使用，会降低阿司匹林对心血管的保护作用，应避免合用的药物是
A. 阿托伐他汀
B. 格列齐特
C. 贝那普利
D. 布洛芬
E. 奥美拉唑

正确答案：D。布洛芬

解析：本题考查药物的相互作用。布洛芬（D对）长期大剂量使用，会降低阿司匹林对心血管的保护作用；布洛芬可同时抑制COX-1和COX-2，与阿司匹林合用时，可竞争性的占据血小板COX-1的乙酰化位点，减弱阿司匹林的抗血小板聚集作用，增加发生心血管事件的风险；阿托伐他汀（A错）为羟甲基戊二酰辅酶A抑制剂；格列齐特（B错）应慎与西咪替丁、咪康唑、利福平和圣约翰草提取物合用；贝那普利（C错）属血管紧张素转化酶抑制剂（ACEI），心力衰竭患者同时服用水杨酸盐会降低ACEI的有效性；奥美拉唑（E错）与氯吡格雷合用会降低氯吡格雷的疗效，使得患者的血栓不良事件增加。